患者，男，50岁。现昏仆抽搐吐涎，两目上视，口中如作猪羊叫，平时情绪急躁，心烦失眠，咳痰不爽，口苦而干，舌红苔黄腻，脉弦滑数。治疗应首选
A. 知柏地黄丸合定痫丸
B. 天王补心丹合定痫丸
C. 顺气导痰汤合二阴煎
D. 龙胆泻肝汤合涤痰汤
E. 滋水清肝饮合定痫丸

正确答案：D。龙胆泻肝汤合涤痰汤

解析：中老年男性，昏仆抽搐吐涎，两目上视，口中如作猪羊叫，为癫痫发作，属中医“痫证”范畴，患者平时情绪急躁，心烦失眠，咳痰不爽，口苦而干，舌红苔黄腻，脉弦滑数，辨证为肝火痰热证，治宜清肝泻火，化痰息风。方药用龙胆泻肝汤合涤痰汤加减（D对）。知柏地黄丸合定痫丸、滋水清肝饮合定痫丸适用于肝肾阴虚之痫证（AE错）。天王补心丹合定痫丸适用于心肾阴虚之痫证（B错）。顺气导痰汤合二阴煎适用于阴虚痰扰之痫证（C错）。